下列哪项是孕激素的生理功能
A. 促进子宫发育
B. 促进女性第二性征发育
C. 使阴道上皮细胞增生、角化
D. 通过中枢神经系统使体温升高0.3～0.5度
E. 对防止高血压及冠状动脉硬化有一定的作用

正确答案：D。通过中枢神经系统使体温升高0.3～0.5度

解析：孕激素的生理作用是作用于下丘脑体温调节中枢使基础体温在排卵后升高0.3-0.5℃，所以孕激素是通过中枢神经系统调节体温（D对）。另外，孕激素的生理作用还包括降低子宫平滑肌兴奋性及其对缩宫素的敏感性，抑制子宫收缩，有利于胚胎及胎儿宫内生长发育；促进子宫发育为雌激素作用而非孕激素（A错）。雌激素能促使乳腺管增生，乳头、乳晕着色，促进其他第二性征发育，而孕激素作用为促进乳腺小叶及腺泡发育，不刺激其他性征发育，故促进第二性征发育起作用（B错）的是雌激素，非孕激素。孕激素对阴道上皮的作用是加快阴道上皮的细胞脱落，不是增生、角化（C错）。孕激素能促进水钠排出，但对动脉血管收孕激素缩及血脂斑块无调节作用，故无防止高血压及冠状动脉硬化的作用（E错）。